以下常用来说明两者相互对比的水平的指标，称为
A. 算数平均数
B. 几何平均数
C. 标准差
D. 相对比
E. 构成比

正确答案：D。相对比

解析：相对比是指两个有关的指标之比，常用来说明两者相互对比的水平。掌握“分类资料的统计描述与推断”知识点。